有关粉体粒径测定的不正确表述是
A. 用显微镜法测定时，一般需测定200～500个粒子
B. 沉降法适用于100㎛以下粒子的测定
C. 筛分法常用于45㎛以上粒子的测定
D. 中国药典中的九号筛的孔径大于一号筛的孔径
E. 工业筛用每一英寸长度上的筛孔数目表示

正确答案：D。中国药典中的九号筛的孔径大于一号筛的孔径